男，20岁，常伴发低热，X线下出现肺门阴影，判断患者可能的疾病
A. 原发性肺结核
B. 支气管肺癌
C. 肺炎
D. 肺结节病
E. 肺气肿

正确答案：A。原发性肺结核

解析：根据题干：青年男性，常伴低热，体征：X线下出现肺一般老年性患者多发（B错）。肺炎患者一般会是急性期，常伴高热（C错）。肺结节病、肺气肿很少出现发热现象（DE错）。